抑制5-HT再摄取的药物是
A. 氟硝西泮
B. 奋乃静
C. 碳酸锂
D. 氟西汀
E. 氟哌啶醇

正确答案：D。氟西汀

解析：本题考查抗抑郁药的作用机制。抑制5-HT再摄取的药物是氟西汀（D对）。氟西汀为选择性5-羟色胺再摄取抑制剂 （SSRI），主要通过选择性抑制5-HT的再摄取，增加突触间隙5-HT浓度，从而增强中枢5-HT能神经功能，发挥抗抑郁作用。氟硝西泮（A错）是苯二氮䓬类镇静催眠药。奋乃静（B错）和氟哌啶醇（E错）是抗精神分裂药。碳酸锂（C错）是抗躁狂药。